治疗帕金森综合征
A. 解磷定
B. 安坦
C. 新斯的明
D. 阿托品
E. 左旋多巴

正确答案：E。左旋多巴

解析：本题考查帕金森病用药。左旋多巴（E对）为拟多巴胺类药，能够补充纹状体中多巴胺的不足，发挥抗帕金森病的作用。解磷定（A错）用于有机磷中毒的解救。安坦（苯海索）（B错）主要用于帕金森早期轻症患者、不能使用左旋多巴或DA受体激动药的患者、抗精神病药所致的药源性帕金森综合征患者。新斯的明（C错）用于重症肌无力、手术后腹气胀及尿潴留、阵发性室上性心动过速、肌松药的解毒。阿托品（D错）可用于松弛内脏平滑肌，升高眼压。